易透过血脑屏障进入脑脊液的抗真菌药是
A. 氟康唑
B. 制霉菌素
C. 酮康唑
D. 咪康唑
E. 灰黄霉素

正确答案：A。氟康唑

解析：本题考查氟康唑的药理作用。易透过血脑屏障进入脑脊液的抗真菌药是氟康唑（A对）。氟康唑可以透过血脑屏障进入脑脊液治疗真菌感染引起的脑膜炎等。制霉菌素（B错）、酮康唑（C错）、咪康唑（D错）、灰黄霉素（E错）不易透过血脑屏障进入脑脊液。